宜选用牛黄解毒丸的是
A. 某男，34岁，因胃肠积热而头痛眩晕、目赤耳鸣、口燥咽干、大便燥结
B. 某男，42岁，因风热上攻、肺胃热盛而头晕目眩、牙齿疼痛、口舌生疮、大便秘结、小便短赤
C. 某男，50岁，因肝胆湿热而头晕目赤、耳鸣耳聋、胁痛口苦、尿赤涩痛
D. 某女，37岁，因火毒血热而身热烦躁、目赤口疮、牙龈肿痛、吐血、咯血、大便秘结
E. 某女，25岁，因火热内盛而咽喉肿痛、牙龈肿痛、口舌生疮、目赤肿痛

正确答案：E。某女，25岁，因火热内盛而咽喉肿痛、牙龈肿痛、口舌生疮、目赤肿痛

解析：本题考查的是牛黄解毒丸的主治。宜选用牛黄解毒丸的是某女，25岁，因火热内盛而咽喉肿痛、牙龈肿痛、口舌生疮、目赤肿痛（E对）。牛黄解毒丸：【主治】火热内盛所致的咽喉肿痛、牙龈肿痛、口舌生疮、目赤肿痛。牛黄至宝丸：【主治】胃肠积热所致的头痛眩晕、目赤耳鸣、口燥咽干、大便燥结（A错）。黄连上清丸：【主治】风热上攻、肺胃热盛所致的头晕目眩、暴发火眼、牙齿疼痛、口舌生疮、咽喉肿痛、耳痛耳鸣、大便秘结、小便短赤（B错）。龙胆泻肝丸：【主治】肝胆湿热所致的头晕目赤、耳鸣耳聋、耳肿疼痛、胁痛口苦、尿赤涩痛、湿热带下（C错）。一清颗粒：【主治】火毒血热所致的身热烦躁、目赤口疮、咽喉及牙龈肿痛、大便秘结（D错）、吐血、咯血、衄血、痔血；咽炎、扁桃体炎、牙龈炎见上述证候者。